一旦发生药物不良反应，首先应
A. 及时供氧
B. 洗胃、灌肠
C. 服用鸡蛋清
D. 饮服甘草、绿豆汤
E. 停用一切药物，同时禁食

正确答案：E。停用一切药物，同时禁食